患者，女，20岁，未婚近3个月来，月经先期而至，量多色深红，兼见心烦易怒，口苦咽干，尿黄便结，舌红苔黄，脉弦数，此属
A. 气不摄血
B. 肝气郁滞
C. 瘀血积滞
D. 阴虚火旺
E. 肝郁血热

正确答案：E。肝郁血热

解析：月经先期，经色深红，质稠量多，为血热。多因素体阳盛，感受热邪，或肝郁化火，热扰于血，或肾阴亏损，阴血不足，虚热内生所致（E对）。月经先期，经色淡红，质稀量多，气短乏力，为气虚不摄。多因脾气亏虚、肾气不足，冲任不固所致（A错）。月经先后不定期多因肝气郁滞，气机逆乱，或脾肾虚损冲任失调，血海蓄溢失常所致（B错）。月经后期，经色紫暗，夹有血块等，为血瘀，可因气滞血瘀、寒凝血瘀、痰湿阻滞、冲任不畅所致（C错）。因患者无五心烦热、潮热盗汗等阴虚表现，故不属于阴虚火旺（D错）。